宜放在斗架中上层的药有
A. 黄芪、党参、甘草
B. 玫瑰花、玳瑁花、厚朴花
C. 龙骨、龙齿、牡蛎
D. 大黄炭、黄苓炭、黄柏炭
E. 络石藤、青风藤、海风藤

正确答案：A。黄芪、党参、甘草